粉尘在呼吸道的阻留与以下因素有关
A. 粉尘粒子的直径
B. 粉尘粒子的比重
C. 粉尘粒子的形状
D. 粉尘粒子的荷电性
E. 以上全部

正确答案：E。以上全部

解析：本题考查粉尘在呼吸道中阻留的有关因素。粒径或质量小的颗粒越多，分散度越高，粉尘粒子分散度越高，其在空气中飘浮的时间越长，沉降速度越慢，被人体吸入的机会就越多。不同种类的粉尘由于粉尘的密度和形状不同，同一粒径的粉尘在空气中的沉降速度不同，因此引入了空气动力学直径这一概念。同一空气动力学直径的尘粒，在空气中具有相同的沉降速度和悬浮时间，并趋向于沉降在人体呼吸道内的相同区域。粒子是具有荷电性的，同性电荷相斥增强了空气中粒子的稳定程度，异性电荷相吸使尘粒撞击、聚集并沉降。 一般来说，荷电尘粒在呼吸道内易被阻留（E对ABCD错）。